腕骨
A. 8块腕骨共同排列在一个平面内
B. 近侧列由大、小多角骨、头状骨及钩骨组成
C. 分为近、远两列，每列各4块骨
D. 远侧列4块参与构成腕关节
E. 均不对

正确答案：C。分为近、远两列，每列各4块骨

解析：腕骨分为近、远两列，每列各4块骨（C对）。近侧列由桡侧向尺侧分别为：手舟骨、月骨、三角骨和豌豆骨（B错）。手舟骨、月骨和三角骨近端形成的椭圆形关节面，与桡骨腕关节面及尺骨下端的关节盘构成桡腕关节（D错）。8 块腕骨构成掌面凹陷的腕骨沟（A错）。